保留针对“非己”抗原的识别和反应能力属于适应性免疫应答的
A. 特异性
B. 记忆性
C. 耐受性
D. 恒常性
E. 选择性

正确答案：C。耐受性